关于颗粒剂的说法，错误的是
A. 处方中含有挥发性成分较多的饮片宜采用“双提法”提取
B. 制粒时清膏：糖粉：糊精的比例一般为1:3:1
C. 挥发油等挥发性成分可制成β-环糊精包合物混匀于颗粒
D. 除另有规定外，颗粒剂含水量不得过9.0%
E. 泡腾颗粒系由药物与泡腾崩解剂制成的颗粒剂

正确答案：D。除另有规定外，颗粒剂含水量不得过9.0%

解析：本题考查颗粒剂的质量要求。关于颗粒剂的说法，错误的是除另有规定外，颗粒剂含水量不得过9.0%（D错，为本题正确答案）。颗粒剂：除另有规定外，中药颗粒剂含水分不得过8.0%。处方中所含有的挥发油及水溶性成分较多时，采用双提法（A对）。颗粒剂辅料用量清膏：糖粉：糊精的比例一般为1:3:1（B对）。挥发油采用用β-环糊精包合后混入颗粒剂（C对）。泡腾颗粒系指含有碳酸氢钠和有机酸，遇水可放出大量气体而呈泡腾状的颗粒剂（E对）。泡腾颗粒中的药物应是易溶性的，加水产生气泡后应能溶解。